低钾血症时
A. 神经肌肉兴奋性降低
B. 心肌兴奋性降低
C. 两者均有
D. 两者均无
E. 无

正确答案：A。神经肌肉兴奋性降低

解析：低钾血症时由于细胞外液钾浓度急剧降低，细胞内液钾浓度和细胞外液钾浓度的比值变大，静息电位(Em)负值增大，与阈电位(Et)之间的距离(Em-Et)增大，神经肌肉兴奋性降低（A对）。细胞外液钾浓度降低，心肌细胞膜对K⁺的通透性下降，静息电位(Em)负值减小，与阈电位(Et)之间的距离(Em-Et)减小，心肌兴奋性升高（B错）。